上下颌骨包绕牙根周围的突起部分
A. 牙槽骨
B. 牙槽窝
C. 牙槽嵴
D. 牙槽间隔
E. 牙根间隔

正确答案：A。牙槽骨

解析：牙槽骨是上下颌骨包绕牙根周围的突起部分。掌握“上颌骨解剖特点”知识点。